高热3～5天，热退疹出，此为
A. 麻疹
B. 幼儿急疹
C. 风疹
D. 猩红热
E. 水痘

正确答案：B。幼儿急疹

解析：幼儿急疹又称婴儿玫瑰疹，是人类疱疹病毒6、7型导致的婴幼儿期常见的一种发疹性热病，典型临床表现是：发热持续3～5天，体温多达39℃或更高，但全身症状较轻；热退后出疹，皮疹为红色斑丘疹，迅速遍布于躯干及面部，2～3天皮疹消失，无色素沉着及脱屑，故高热3～5天，热退疹出是幼儿急疹（B对）。麻疹（A错）是小儿时期常见的一种急性呼吸道传染病，临床以发热、上呼吸道炎症、结膜炎、麻疹黏膜斑及全身斑丘疹为特征，其发热与皮疹的关系为发热3～4天出疹，出疹期热更高。风疹（C错）是由风疹病毒引起的急性呼吸道传染病，临床以发热，皮疹及耳后、枕后、颈部淋巴结肿大为特征，其发热与皮疹的关系为发热1～2天出疹。猩红热（D错）是由A组乙型溶血性链球菌感染后引起的急性发疹性呼吸道传染病，临床以发热、咽峡炎、全身弥漫性猩红色皮疹和疹退后皮肤脱屑为特征，其发热与皮疹的关系为发热数小时～1天出疹，出疹期高热。水痘（E错）的临床特征为发热，皮肤黏膜分批出现的瘙痒性斑、丘、疱疹及结痂，且上述各期皮疹可同时存在，发热表现为低热或中等程度发热，持续1～2天即迅速进入出疹期。